患者，女性，28岁。手术后出现表情淡漠，嗜睡，烦躁，腹胀，心跳加快，心电图早期T波低平，双相倒置，继之ST段下降，Q-T间期延长和U波出现，属于
A. 轻度缺水
B. 中度缺水
C. 重度缺水
D. 低钾血症
E. 高钾血症

正确答案：D。低钾血症

解析：患者出现低钾血症，表情淡漠，嗜睡，烦躁为神经肌肉症状，腹胀为消化系统症状，心跳加快腹胀为循环系统症状，心电图早期T波低平双相倒置，继之ST段下降Q-T间期延长和U波出现（D对）。根据失水程度，将高渗性缺水分为三度：轻度：失水量占体重的2%～4%，除口渴外无其他症状。中度：失水量占体重的4%～6%极度口渴，乏力，眼窝明显凹陷，唇舌干燥，皮肤弹性差，心率加速，尿少，尿比重增高。3.重度：失水量占体重的6%以上。除有上述症状外，可出现烦躁、谵妄、昏迷等脑功能障碍症状、血压下降乃至休克、少尿乃至无尿、氮质血症等（ABC错）。高钾血症的临床表现为神经肌肉传导阻碍、心血管症状。心电图早期改变为T波高尖，基底变窄；当血清钾＞8.0mmol/L时，P波消失，QRS波增宽，QT间期延长。严重时出现房室传导阻滞、心室颤动（E错）。